股骨颈骨折
A. 易发生肱动脉损伤
B. 易发生腘动脉损伤
C. 易发生缺血性骨坏死
D. 易发生桡神经损伤
E. 易发生坐骨神经损伤

正确答案：C。易发生缺血性骨坏死

解析：股骨颈骨折按骨折线部位可分为股骨头下骨折、经股骨颈骨折和股骨颈基底骨折。其中股骨头下骨折时，股骨头的主要供血动脉（骺外侧动脉）中断，使得股骨头严重缺血，因此最容易发生股骨头缺血性坏死（C对）。肱动脉损伤（A错）常发生于伸直型肱骨髁上骨折；桡神经损伤（D错）常见于肱骨中下1/3骨折；腘动脉损伤（B错）常见于股骨下1/3骨折；坐骨神经损伤（E错）多见于髋关节后脱位。